患者，女性，54岁。有甲亢病史，近日因过劳和精神刺激而出现失眠、心悸、胸闷。体检见心率160次/分，心电有明显的心肌缺血改变、窦性心律不齐。此时最好选用
A. 胺碘酮
B. 奎尼丁
C. 普鲁卡因胺
D. 普萘洛尔
E. 利多卡因

正确答案：D。普萘洛尔